女，36岁。间断腹痛腹泻5年，大便3～5次/日，带黏液，无脓血，便后胀痛缓解，受凉及紧张后症状加重，无发热，抗生素治疗无效。体重无减轻。粪隐血试验阴性。最可能的诊断是
A. 溃疡性结肠炎
B. 克罗恩病
C. 慢性细菌性痢疾
D. 肠结核
E. 肠易激综合征

正确答案：E。肠易激综合征

解析：中年女性患者，间断腹痛、腹泻5年（病程6个月以上），大便3～5次/日（排便频率异常），带黏液（粪便性状异常），无脓血（肠易激综合征患者粪便绝无脓血），便后胀痛缓解（符合肠易激综合征的腹痛特点），受凉及紧张后症状加重（精神、饮食等因素常诱使肠易激综合征症状复发或加重）。粪隐血试验阴性。综合该患者的病史、实验室检查，考虑诊断为肠易激综合征（E对）。溃疡性结肠炎（P374）（A错）多有黏液脓血便，粪隐血试验阳性。克罗恩病（P377）（B错）临床以腹痛、腹泻、体重下降、腹块、瘘管形成和肠梗阻为特点。慢性细菌性痢疾（C错）有黏液脓血便，抗生素治疗有效。肠结核（P368）（D错）多有低热、盗汗等结核毒血症状。